健康相关生命质量评价内容不包括哪项
A. 心理状态
B. 身体状态
C. 一般性感觉
D. 社会功能状态
E. 临床检查的验证

正确答案：E。临床检查的验证